休克代偿期表现不包括
A. 血压下降
B. 兴奋
C. 过度通气
D. 烦躁
E. 舒张压升高

正确答案：A。血压下降

解析：休克代偿期，血容量不足程度低，由于机体对循环血量减少有相应的代偿能力，病人交感神经兴奋，肾上腺激素随之分泌增加，心率加快，引起收缩压正常或轻度增高（A错，为本题正确答案），舒张压增高（E对），脉压减小。表现为精神紧张、兴奋（B对）或烦躁（D对）不安、皮肤苍白、过度通气（C对）、尿量减少等症状。